以下哪项是一种囊性的牙源性良性肿瘤
A. 成釉细胞瘤
B. 含牙囊肿
C. 根尖周囊肿
D. 牙龈瘤
E. 牙源性钙化囊性瘤

正确答案：E。牙源性钙化囊性瘤

解析：牙源性钙化囊性瘤是一种囊性的牙源性良性肿瘤，成釉细胞瘤虽属良性肿瘤，但其生长具有局部侵袭性，术后复发率较高，也有恶变甚至远处转移。掌握“牙源性钙化上皮、囊性瘤”知识点。